提示急性下壁心肌梗死的心电图导联是
A. Ⅱ，aVF
B. V₁，V₂，V₃
C. V₃，V₄
D. Ⅰ，aVL
E. V₅，V₆

正确答案：A。Ⅱ，aVF

解析：Ⅱ，Ⅲ，aVF（A对）导联提示急性下壁心肌梗死。V₁，V₂，V₃（B错）导联提示急性前间隔心肌梗死。V₃，V₄（C错）导联提示急性局限前壁心肌梗死。Ⅰ、aVL（D错）导联提示急性高侧壁心肌梗死。V₅，V₆（E错）提示急性前侧壁心肌梗死。